女，25岁，妊娠35周。头晕、乏力、心悸2个月。既往体健。血常规：Hb80g/L，MCV108fl，MCH35pg，MCHC33%，WBC3.6×10⁹/L，Plt95×10⁹/L，网织红细胞0.02。为明确诊断，首先应进行的检查是
A. 尿Rous试验
B. 粪隐血试验
C. 血清铁、铁蛋白测定
D. Coombs试验
E. 血清叶酸、维生素B₁₂测定

正确答案：E。血清叶酸、维生素B₁₂测定

解析：孕期巨幼细胞贫血的主要临床表现为乏力、头晕、心悸以及皮肤黏膜苍白，外周血象为Hb＜110g/L，血细胞比容降低，MCV＞100fl，MCH＞32pg，Plt（血小板计数正常值100～300×10⁹/L）减少，网织红细胞（正常值0.05）减少，根据患者的临床表现和实验室检查，最可能的诊断为巨幼细胞贫血。巨幼细胞贫血是由于缺乏叶酸或维生素B12所引起，因此为明确诊断，首先进行的检查为血清叶酸、维生素B₁₂测定（E对）。尿Rous试验（A错）是慢性血管内溶血的诊断依据。粪隐血试验（B错）是消化道出血的诊断依据。血清铁、铁蛋白测定（C错）是缺铁性贫血的诊断依据。Coombs试验（D错）是诊断自身免疫性溶血性贫血的重要指标。